能改善稳定型心绞痛患者临床预后的药物是
A. 速效救心丸
B. 硝苯地平
C. 单硝酸异山梨酯
D. 硝酸甘油
E. 阿司匹林

正确答案：E。阿司匹林

解析：能改善稳定型心绞痛患者临床预后的药物是阿司匹林（E对），主要通过抑制环氧化酶和血栓烷A₂的合成达到抗血小板聚集的作用。速效救心丸（A错）、硝苯地平（B错）、单硝酸异山梨酯（C错）、硝酸甘油（D错）主要是改善缺血、减轻症状的药物。